男性，45岁。诉左下颌后牙出现不适6个月求治。口腔检查：左下56残冠，叩诊（±），松动（-），已做过牙髓治疗，牙龈稍红，无法再修复，拟拔除。口内其他牙未见明显异常。X线片示：左下6远中根尖有阴影，距离下颌神经管较近。左下56拔除时断根，颊侧切开去骨后取出，2天后出现激烈疼痛，并向耳颞部、下颌下区放散。口内检查：左下56牙槽窝有腐败变性的残留血凝块，有恶臭。引起疼痛的原因是干槽症，最佳应急处理方法是
A. 局麻下彻底去除牙槽窝内腐败物，冲洗后填入碘仿纱条
B. 服用大量抗生素
C. 消炎漱口液含漱
D. 局部封闭止痛
E. 服用止痛药

正确答案：A。局麻下彻底去除牙槽窝内腐败物，冲洗后填入碘仿纱条

解析：本题考查干槽症的最佳应急处理方法。干槽症的治疗原则是通过彻底的清创及隔离外界对牙槽窝的刺激，以达到迅速止痛，缓解患者痛苦，促进愈合的目的。最佳处理方法为：局麻下彻底去除牙槽窝内腐败物，生理盐水冲洗后填入碘仿纱条（A对）。干槽症的感染学说认为干槽症是一种骨创感染，但迄今为止，单一的病原菌尚未发现，服用大量抗生素（B错），不仅不能有效缓解症状，还容易造成口腔内菌群失调。使用消炎漱口液含漱（C错）可在一定程度上保持口腔清洁，杀灭口腔内部分细菌，减少创口感染，但这只是起辅助作用的治疗方法，并不是最佳的应急处理方法。局部封闭止痛（D错）和服用止痛药（E错）只能暂时缓解剧烈疼痛，不能从根本上解决干槽症的问题。